急性弥漫性増生性肾小球肾炎特点是
A. 弥漫性系膜细胞和基质增生
B. 基底膜和上皮细胞间有驼峰状或小丘状致密物质沉积
C. 弥漫性肾小球内大量新月体或环状体形成
D. 电镜下呈弥漫性肾小球脏层细胞足突消失
E. 是肾病综合征的重要原因

正确答案：B。基底膜和上皮细胞间有驼峰状或小丘状致密物质沉积

解析：急性弥漫性增生性肾小球肾炎的病变特点是毛细血管内皮细胞和系膜细胞增生（A错），电镜检查显示基底膜和上皮细胞间有驼峰状或小丘状致密物质沉积（B对）。弥漫性肾小球内大量新月体或环状体形成（C错）是急进性肾小球肾炎（P267）的病变特点。电镜下呈弥漫性肾小球脏层细胞足突消失（D错）是微小病变性肾小球肾病（P270）的病变特点。急性弥漫性增生性肾小球肾炎的临床表现为急性肾炎综合征（P265），不会引起肾病综合征（E错）。